男性，突发寒战，体温39℃左右，腹泻10余次，伴里急后重，便为稀便，很快转化为脓血便。便常规红细胞5/HP，白细胞10/HP，脓细胞（++）。该患者治疗首选药物
A. 先锋霉素
B. 氧氟沙星
C. 红霉素
D. 氯霉素
E. 黄连素

正确答案：B。氧氟沙星

解析：男性患者，突发寒战，体温39℃左右，腹泻10余次（细菌性痢疾急性期的常见表现），伴里急后重（提示病变累及直肠），粪便由稀便很快转为脓血便（菌痢能导致肠黏膜坏死、溃疡），便常规见红细胞、白细胞及脓细胞（符合菌痢的粪便检查结果），综合该患者的病史、体查、实验室检查，该患者考虑诊断为细菌性痢疾，治疗首选药物为氧氟沙星（B对）。喹诺酮类药物（包括氧氟沙星）具有抗菌谱广，口服吸收好，不良反应小，耐药菌株少等特点，因此是治疗细菌性痢疾的首选药物。当菌体对喹诺酮类药物产生耐药时，可考虑应用二线药物，包括先锋霉素（即头孢菌素类）（A错）、阿奇霉素等（P182）。红霉素（C错）对痢疾杆菌有一定的作用，但疗效不及喹诺酮类药物。氯霉素（八版药理学P393）（D错）对造血系统可能产生致命性的毒性，当其他药物能够选用时，绝不要使用氯霉素。黄连素（E错）有减少肠道分泌的作用，一般与抗生素联合治疗菌痢。